胰腺癌最常见的好发部位是
A. 胰腺头部
B. 胰腺尾部
C. 全胰腺
D. 异位胰腺
E. 胰腺体部

正确答案：A。胰腺头部

解析：胰腺癌最常见的好发部位是胰腺头部（A对），约占胰腺癌的70%～80%。